拔牙后，血管芽的形成，拔牙创血块机化开始的时间是
A. 半小时
B. 1小时
C. 6小时
D. 12小时
E. 24小时

正确答案：E。24小时

解析：约24小时，即有成纤维细胞自牙槽骨壁向血凝块内延伸生长，同时来自邻近血管的内皮细胞增殖，形成血管芽，并连成血管网，肉芽组织形成血块机化开始。掌握“牙拔除术前准备、器械、心血管及拔牙愈合过程”知识点。